女，31岁。月经不规律3年，闭经7个月，溢乳2个月。对诊断最有价值的测定项目是
A. 孕激素
B. 雄激素
C. 催乳素
D. 促甲状腺素
E. 雌激素

正确答案：C。催乳素

解析：中年女性患者，月经不规律3年，闭经7个月，溢乳2个月。综合患者的症状、体征，初步诊断为高催乳素血症，对诊断最有价值的测定项目是催乳素（C对），血清催乳素﹥1.14nmol/L（25µg/L）即可确诊。孕激素（A错）适用于排卵监测、评价黄体功能、辅助诊断异位妊娠、辅助诊断先兆流产、观察胎盘功能、孕酮替代疗法的监测。雄激素（B错）、促甲状腺素（D错）均不是高催乳素血症的测定项目。雌激素（E错）适用于监测卵巢功能、监测胎儿-胎盘单位功能，雌激素水平偏低也可见于高催乳素血症，但不是最有价值的测定项目。